下列属于人群健康状况影响因素的是
A. 遗传因素和环境因素
B. 遗传因素、环境因素、卫生服务和行为生活方式
C. 自然因素和社会因素
D. 生物因素、心理因素和社会因素
E. 生物因素和卫生行为生活方式

正确答案：B。遗传因素、环境因素、卫生服务和行为生活方式

解析：本题考查人群健康状况的影响因素。人群健康状况的影响因素有：遗传因素、环境因素、卫生服务和行为生活方式（B对ACDE错）。